关于中耳的说法何者正确
A. 向内与内耳道相连通
B. 向外与外耳道相通
C. 向上与颅腔相通
D. 向前借半规管与鼻咽相通
E. 岬的后下方有蜗窗

正确答案：E。岬的后下方有蜗窗

解析：中耳向外借鼓膜与外耳道相隔（B错），向内毗邻内耳（A错），向前以咽鼓管通向鼻咽部（D错）。鼓室上壁又称盖壁，由颞骨岩部前外侧面的鼓室盖构成，分隔鼓室与颅中窝（C错）。鼓室内侧壁有岬，其后下方有一圆形小孔，称蜗窗或圆窗（E对）。